由胰岛B细胞分泌
A. 胰蛋白酶
B. 胰多肽
C. 生长抑素
D. 胰岛素
E. 胰高血糖素

正确答案：D。胰岛素

解析：胰岛B细胞也称胰岛β细胞，分泌胰岛素(D对)。